向肝脏输送血液最多的血管是
A. 肝静脉
B. 胃右动脉
C. 肝动脉
D. 门静脉
E. 肠系膜上动脉

正确答案：D。门静脉

解析：肝脏由双重血液供应，来自门静脉的约占70%～75%（D对），来自肝动脉的约占25%～30%（C错）。